霍乱最常见的严重并发症是
A. 肠穿孔
B. 肠出血
C. 急性肾衰竭
D. 急性肺水肿
E. 低钾综合征

正确答案：C。急性肾衰竭

解析：霍乱患者皮肤因脱水而干燥，心、肝、脾等脏器缩小。胃肠道的浆膜层干粘，肠黏膜轻度炎症，肠腔内充满米泔水样液体。胆囊内含有粘稠浑浊的胆汁。而肾脏往往肿大，肾小球及间质毛细血管扩张，肾小管上皮有浊肿、变性及坏死，进而出现急性肾衰竭（C对）；不会出现肠穿孔（A错）；有肠出血（B错）者排出洗肉水样便，但并非并发症；脱水期因代谢性酸中毒出现呼吸增快，但没有急性肺水肿（D错）；低钾综合征（E错）为脱水期重要表现，因腹泻使钾盐大量丢失，并非严重并发症。